礞石的功效是
A. 清热化痰，软坚散结
B. 清热化痰，利气宽胸
C. 清热化痰，清心定惊
D. 消痰下气，平肝镇惊
E. 消痰行水，降气止呕

正确答案：D。消痰下气，平肝镇惊

解析：本题考查的是礞石的功效。礞石的功效是消痰下气，平肝镇惊（D对）。礞石：【功效】消痰下气，平肝镇惊。海蛤壳：【功效】清热化痰，软坚散结（A错），利尿消肿，制酸止痛。瓜蒌：【功效】清肺润燥化痰，利气宽胸（B错），消肿散结，润肠通便。天竺黄：【功效】清热化痰，清心定惊（C错）。旋覆花：【功效】消痰行水，降气止呕（E错）。